霍奇金淋巴瘤最典型的临床表现是
A. 发热
B. 面色苍白
C. 无痛性淋巴结肿大
D. 肝脾肿大
E. 体重减轻

正确答案：C。无痛性淋巴结肿大

解析：霍奇金淋巴瘤（HL）最典型的临床表现是无痛性淋巴结肿大（C对）。发热（A错）、体重减轻（E错）是霍奇金淋巴瘤常见的全身症状；面色苍白（B错）为贫血表现，可见于淋巴瘤、急性白血病、营养不良等患者；肝脾肿大（D错）可见于晚期淋巴瘤、急性白血病、门静脉高压等疾病；发热、体重减轻、面色苍白、肝脾肿大均不具有特异性。